下颌处于安静状态时，上下牙列之间的距离称为
A. 正中位
B. 息止颌位
C. 息止（牙合）间隙
D. 颌间距离
E. 垂直距离

正确答案：C。息止（牙合）间隙

解析：本题考查息止（牙合）间隙。当人直立或端坐，两眼平视前方，不咀嚼、不吞咽、不说话时，提颌肌群轻微收缩以对抗下颌骨所承受的重力，下颌所处的位置即下颌姿势位，又称息止颌位（B错），此时上下牙列之间的距离为息止（牙合）间隙（C对）。上下牙列最广泛接触时下颌所处的位置即牙尖交错位，又称正中颌位或正中位（A错）。颌间距离指全口牙齿缺失患者，下颌位于正中位时，上下颌牙槽嵴顶之间的间隙距离（D错）。垂直距离是指自然牙列，下颌位于牙尖交错（牙合）时，鼻底到颏底之间的距离（E错）。